男，40岁，10小时前搬重物时突发上胸部疼痛呈撕裂样，并逐渐向下胸部和腹部延伸。高血压病史15年。查体：170/100mmHg（左上肢），BP140/75mmHg（右上肢）。心率105次/分，心律齐。腹平软，Murphy征阴性。CK-MB正常。心电图：正常。胸部X线片显示主动脉明显增宽。该患者胸痛最可能的病因是
A. 急性心肌梗死
B. 变异型心绞痛
C. 主动脉夹层
D. 急性胆囊炎
E. 急性心包炎

正确答案：C。主动脉夹层

解析：患者中年男性，有长期高血压病史，搬重物时突发上胸部撕裂样疼痛，并逐渐向下胸部和腹部延伸（主动脉夹层的典型胸痛特点），查体示左上肢BP170/100mmHg而BP右上肢140/75mmHg（双上肢血压相差较大，正常值小于10～20mmHg），胸部X线片显示主动脉明显增宽，结合患者的病史、临床表现、体检和影像学检查，该患者胸痛最可能的病因是主动脉夹层（C对）。急性心肌梗死（P236）（A错）常有发热、烦躁不安、出汗、恐惧，胸闷或有濒死感，且有特异性的心电图改变和CK-MB升高；变异型心绞痛（P229）（B错）的胸痛时间一般不超过30min，心电图表现为一过性ST段动态改变（抬高）。急性胆囊炎（D错）常为右上腹阵发性或持续性疼痛，Murphy征阳性；急性心包炎（P302）（E错）常可于胸骨左缘第3、4肋间闻及特异性的心包摩擦音；这四种疾病均不会出现双上肢血压相差较大的表现。